男性，35岁。2周前感冒后发寒、发热、咳嗽，1周前咳大量黄色脓性痰，痰中带血，经青霉素头孢噻肟等治疗无效。体检：体温40℃，呼吸急促，双肺中下闻及湿啰音。血白细胞计数25×10⁹/L，中性粒细胞0.90。X线胸片显示双肺中下斑片状实变阴影，并有多个脓肿和肺气囊肿。本例诊断应首先考虑为
A. 肺炎球菌肺炎
B. 葡萄球菌肺炎
C. 克雷伯杆菌肺炎
D. 支原体肺炎
E. 干酪性肺炎

正确答案：B。葡萄球菌肺炎

解析：患者为中青年男性，起病急骤，寒战、高热，胸痛，咳黄脓痰且量多、带血丝（为葡萄球菌肺炎典型的痰液表现），血WBC25×10⁹/L（正常值为4～10×10⁹/L），中性粒细胞比例0.90（正常值为0.50～0.75），提示存在感染，X现显示双肺中下斑片状实变阴影，并有多个脓肿和肺气囊肿（为葡萄球菌肺炎典型的胸片改变），根据其临床表现和辅助检查，可诊断为葡萄球菌肺炎（B对）（葡萄球菌为G+菌，三代头孢菌素如头孢噻肟疗效不佳，且对青霉素的耐药率已高达90%左右）。肺炎球菌肺炎（A错）痰少，可带血或呈铁锈色，X线表现为肺实变，无脓肿和肺气囊肿。克雷伯杆菌肺炎（C错）有咳砖红色胶冻样痰、头孢噻肟等三代头孢对其有效等特点，与本病例不符。支原体肺炎（D错）起病缓慢，阵发性刺激性咳嗽，痰少，血WBC常正常或略升高，与本病例不符。干酪性肺炎（E错）为继发性肺结核，多为长期午后潮热，X线表现为均匀毛玻璃状阴影，与本病例不符。